男，56岁。反复上腹痛2年，加重3个月。腹痛无明显规律性，伴乏力，间断黑便。3个月以来体重减轻10Kg，查体：T36.5℃，P80次／分，R18次／分，BP120/80mmHg。皮肤巩膜无黄染，双肺呼吸音清，未闻及干湿性啰音，心律齐，腹软，无压痛。血常规：Hb110g/L，WBC9.6×10⁹/L，N0.86，Plt158×10⁹/L。对明确诊断最有价值的检查是
A. 胃液分析
B. 胃镜
C. 腹部B超
D. 腹部CT
E. 胃脱落细胞检查

正确答案：B。胃镜

解析：男，56岁。反复上腹痛2年（慢性病程），加重3个月。腹痛无明显规律性，伴乏力，间断黑便（慢性消化道出血）。3个月以来体重减轻10Kg（体重下降），查体：T36.5℃，P80次／分，R18次／分，BP120/80mmHg。皮肤巩膜无黄染，双肺呼吸音清，未闻及干湿性啰音，心律齐，腹软，无压痛。血常规：Hb110g/L，WBC9.6×10⁹/L，N0.86，Plt158×10⁹/L（血常规未见明显异常）。消化道出血为明确诊断应行胃镜检查（B对）。